影响血药浓度的病理因素包括
A. 心脏疾患
B. 胃部疾患
C. 肝功能损害
D. 肾功能损害
E. 肠道疾患

正确答案：A、B、C、D、E。心脏疾患；胃部疾患；肝功能损害；肾功能损害；肠道疾患